患者男性，80岁，出现便血，伴贫血、腹痛、右下腹肿块l个月，无发热，伴明显消瘦，腹胀，应首先考虑诊断
A. 皮脂腺囊肿
B. 阑尾类癌
C. 结肠癌
D. 溃疡性结肠炎
E. 肠结核

正确答案：C。结肠癌

解析：本题患者80岁，出现便血，伴贫血腹痛右下腹肿块l个月，无发热，伴明显消瘦，腹胀，应首先考虑诊断结肠癌（C对）。慢性阑尾炎大多数患者过去存在急性阑尾炎发作的病史，慢性阑尾炎症状以右下腹疼痛为主，疼痛位置相同，疼痛程度较急性阑尾炎轻，常呈复发性疼痛，迁延不愈可持续数月甚至数年。有部分患者无急性阑尾炎病史，仅是表现为间断的右下腹隐痛或不适。当按压右下腹（阑尾部位）时可有轻到中度压痛，位置局限也较固定；左侧卧位时，医生触摸右下腹可能会触及条索状肿物（A错）。阑尾类癌是发生于阑尾黏膜下的一类肿瘤，好发于女性，发生病因往往考虑与神经内分泌或者环境、遗传，甚至激素都有一定的相关性，病因仍然不是很明确。因发生在阑尾上，所以与阑尾炎临床表现很相似，比如右下腹疼痛、压痛，甚至到后期会出现发烧、右下腹反跳痛，甚至在右下腹能摸到包块。其治疗原则仍然是手术治疗，预后比较好（B错）。溃疡性结肠炎除少数患者起病急骤外，一般起病缓慢，病情轻重不一。症状以腹泻为主，排出含有血、脓和黏液的粪便，常伴有阵发性结肠痉挛性疼痛，并里急后重，排便后可获缓解。轻型患者症状较轻微，每日腹泻不足5次。重型每日腹泻在5次以上，为水泻或血便，腹痛较重，有发热症状，体温可超过38.5℃，脉率大于90次/分，部分患者有肠道外表现，如结节性红斑、虹膜炎、慢性活动性肝炎及小胆管周围炎等（D错）。肠结核诊断1.肠梗阻 主要发生在增生性肠结核，见于晚期患者；2.肠穿孔 主要为亚急性和慢性穿孔，可在腹腔内形成脓肿，破溃后形成肠瘘，肠出血较少见，偶有急性肠穿孔。可因合并结核性腹膜炎而出现其相关并发症（E错）。